关于聚乙二醇4000治疗便秘的说法，错误的是
A. 适用人群为成人及8岁以上儿童
B. 疗程不宜过长
C. 作用机制为剌激肠道分泌，增加粪便含水量以软化粪便
D. 肠梗阻患者禁用
E. 可用于妊娠期及哺乳期妇女

正确答案：C。作用机制为剌激肠道分泌，增加粪便含水量以软化粪便

解析：本题考查聚乙二醇4000。聚乙二醇4000为渗透性泻药，在肠内形成高渗状态，吸收水分，增加粪便体积，刺激肠道蠕动（C错，为本题正确答案），用于成人及8岁以上儿童（A对）（包括8岁）便秘；渗透性泻药过量应用会导致电解质紊乱，因此疗程不宜过长（B对）；容积性泻药、聚乙二醇、乳果糖可作为妊娠期便秘患者（E对）的首选泻剂；肠梗阻患者禁用（D对）聚乙二醇4000。